血红素铁是指
A. 以Fe（OH）₃络合物形式存在的铁
B. 与蛋白质结合的铁
C. 与有机酸结合的铁
D. 与卟啉结合的铁
E. 血清铁

正确答案：D。与卟啉结合的铁